十二经脉的别络从本经分出的部位是
A. 四肢末端的指趾
B. 肘膝关节以下
C. 肘膝关节以上
D. 肩关节周围
E. 踝关节周围

正确答案：B。肘膝关节以下

解析：十二经脉别络在四肢肘膝关节以下（B对）本经络穴分出后，均走向其相表里的经脉。任脉的别络，从胸骨剑突下鸠尾分出后，散布于腹部；督脉的别络，从尾骨下长强分出后，散布于头部，并走向背部两侧的足太阳经；脾的大络，出于腋下大包穴，散布于胸胁部。全身络脉中，十五络脉较大，络脉中浮行于浅表部位的称为“浮络”，络脉最细小的分支称为“孙络”，遍布全身，难以计数。